厕所是收集和贮存粪便的场所，对其卫生要求，不正确的是
A. 坑式厕所应选土质潮湿，坑底应距地下水位1m以上，距分散式供水水源、饮食行业和托幼机构10m以外的地方
B. 粪池要高出地面，防雨雪水流入，应防渗漏，不污染地下水
C. 有防蝇、防蛆、防鼠、防臭、防溢的设施
D. 采光、照明、通风良好，使用方便，便于保洁
E. 城市公共厕所卫生应符合《城市公共厕所卫生标准》（GB/T 17217—1998）

正确答案：A。坑式厕所应选土质潮湿，坑底应距地下水位1m以上，距分散式供水水源、饮食行业和托幼机构10m以外的地方

解析：本题考查厕所的卫生要求。厕所是收集和贮存粪便的场所，必须符合以下卫生要求：①位置适当：坑式厕所应选土质干燥，坑底应距地下水位2m以上，距分散式供水水源、饮食行业和托幼机构30m以外的地方（A错，为本题正确答案）；②粪池要高出地面，防雨雪水流入，应防渗漏，不污染地下水（B对）；③有防蝇、防蛆、防鼠、防臭、防溢的设施（C对）；④采光、照明、通风良好，使用方便，便于保洁（D对）。城市公共厕所卫生应符合《城市公共厕所卫生标准》（GB/T 17217-1998）（E对）。